艾滋病的病原体是
A. 苍白密螺旋体
B. 人乳头瘤病毒
C. 沙眼衣原体
D. 解脲支原体
E. 人免疫缺陷病毒

正确答案：E。人免疫缺陷病毒

解析：艾滋病（人类免疫缺陷病毒）的病原体是人免疫缺陷病毒（HIV）（E对）。